经间期出血量少，色紫黑，有小血块，少腹胀痛。治疗应首选
A. 知柏地黄汤
B. 清肝止淋汤
C. 血府逐瘀汤
D. 解毒活血汤
E. 逐瘀止血汤

正确答案：E。逐瘀止血汤

解析：经间期出血量少，色紫黑，有小血块为瘀血阻滞于胞络冲任之间，经间期阳气内动，与瘀血相搏，脉络损伤，血不循经，血海失固所致。瘀血内阻，气机不畅，故少腹胀痛，辨为血瘀证。知柏地黄丸功能滋阴降火，主治肝肾阴虚，虚火上炎证（A错）。清肝止淋汤加减功能清热利湿，固冲止血，可用于治疗经间期出血湿热证（B错）。血府逐瘀汤功能活血化瘀，行气止痛，主治胸中血瘀证（C错）。解毒活血汤功能滋阴清热解毒，主治瘟毒吐泻转筋初得者（D错）。经间期出血血瘀证治宜化瘀止血，方选逐瘀止血汤（E对）。